取生药粉末加氯仿振摇后，吸取氯仿液2滴于载玻片上，待干，再滴加10%的盐酸苯肼1滴，加盖玻片镜检，可见杆状结晶的生药是
A. 厚朴
B. 黄连
C. 肉桂
D. 黄芪
E. 砂仁

正确答案：C。肉桂

解析：本题考查的是一般理化鉴别的显微化学反应。取生药粉末加氯仿振摇后，吸取氯仿液2滴于载玻片上，待干，再滴加10%的盐酸苯肼1滴，加盖玻片镜检，可见杆状结晶的生药是肉桂（C对）。显微化学反应：显微化学反应是将中药粉末、切片或浸出液，置于载玻片上，滴加某些化学试剂使产生沉淀、结晶或特殊颜色，在显微镜下观察进行鉴定的一种方法。如黄连（B错）滴加30%硝酸，可见针状小檗碱硝酸盐结晶析出。紫苏叶的某些表皮细胞中含有紫色素，表面制片观察时，滴加10%盐酸溶液立即显红色；或滴加5%氢氧化钾溶液，即显鲜绿色，然后变为黄绿色。丁香切片滴加3%氢氧化钠的氯化钠饱和溶液，油室内有针状丁香酚钠结晶析出。肉桂粉末加三氯甲烷2～3滴，略浸渍，速加2%盐酸苯肼1滴，可见黄色针状或杆状结晶（桂皮醛反应）。槟榔粉末0.5g，加水3～4ml及稀硫酸1滴，微热数分钟，取滤液于载玻片上，加碘化铋钾试液1滴，即发生浑浊，放置后可见石榴红色球形或方形结晶（槟榔碱）。